生物地球化学性疾病的发生主要是由于
A. 人体摄入微量元素过多所致
B. 人体摄入微量元素过少所致
C. 地质地理原因使当地居民摄入微量元素过多或过少所致
D. 环境破坏对地质条件影响使人体摄入矿物质异常所致
E. 饮食中某种元素含量异常所致

正确答案：C。地质地理原因使当地居民摄入微量元素过多或过少所致

解析：本题考查生物地球化学性疾病。生物地球化学性疾病是指由于地球地壳表面化学元素分布不均匀，使某些地区的水和（或）土壤中某些元素过多或过少而引起的某些特异性疾病（C对ABDE错）。